100个患有某病的病例中，50个有暴露于A因子的历史，而在200个未患该病的研究对象中，也有50个有A因子的暴露史，该研究中暴露于A因子的相对危险性约为
A. 1
B. 1.5
C. 2
D. 3
E. 5

正确答案：D。3